女，30岁。活动后心悸、气短半年。查体：心尖部可闻及舒张期隆隆样杂音。该患者所患疾病最少出现的并发症是
A. 心律失常
B. 充血性心力衰竭
C. 急性肺水肿
D. 肺部感染
E. 亚急性感染性心内膜炎

正确答案：E。亚急性感染性心内膜炎

解析：患者青年女性，活动后心悸气短，心尖部可闻及舒张期隆隆样杂音（二尖瓣狭窄的特征性杂音），考虑为二尖瓣狭窄。亚急性感染性心内膜炎（P308）（E对）主要由草绿色链球菌引起，多发生于器质性心脏病，首先为心脏瓣膜病，其次是二尖瓣和主动脉瓣关闭不全，瓣膜狭窄者少见。二尖瓣狭窄时最常见的心律失常（A错）为房颤，也是相对早期的常见并发症。充血性心力衰竭（B错）为晚期常见并发症。急性肺水肿（C错）为重度二尖瓣狭窄的严重并发症。肺静脉压力增高及肺淤血容易合并肺部感染（D错），感染后常诱发或加重心力衰竭。